射血分数为与下列何者的百分比
A. 搏出量/体重
B. 搏出量/体表面积
C. 搏出量/心室舒张末期容积
D. 心输出量/体重
E. 心输出量/心室舒张末期容积

正确答案：C。搏出量/心室舒张末期容积